鼻旁窦积液时最不易引流
A. 额窦
B. 上颌窦
C. 蝶窦
D. 筛窦前、中群
E. 筛窦后群

正确答案：B。上颌窦

解析：上颌窦的开口位置较高，分泌物不易排出，当窦腔积液时，最不易引流，应采取体位引流（B对）。